处方炒三仙、焦三仙中，“三仙”的组成是
A. 山楂、稻芽、神曲
B. 槟榔、麦芽、神曲
C. 麦芽、稻芽、谷芽
D. 山楂、麦芽、神曲
E. 仙茅、仙灵脾、仙鹤草

正确答案：D。山楂、麦芽、神曲

解析：本题考查的是常见的并开药名。处方炒三仙、焦三仙中，“三仙”的组成是山楂、麦芽、神曲（D对）。焦三仙：焦山楂、焦麦芽、焦神曲。炒三仙：炒山楂、炒麦芽、炒神曲。